能够累及釉质，牙骨质，牙本质的龋病是以下哪项
A. 牙釉质龋
B. 邻面龋
C. 冠部的深龋
D. 牙颈部龋
E. 根尖周炎

正确答案：D。牙颈部龋

解析：本题考查牙骨质龋。能够累及釉质，牙骨质，牙本质的龋病是以下牙颈部龋（D对）。由于根面龋好发部位为牙颈部，所以病变常累及颈部的釉质、牙骨质、直接或间接累及牙本质。